藿香的主治病证是
A. 水肿
B. 痰饮
C. 热淋
D. 湿浊困脾
E. 湿痹肿痛

正确答案：D。湿浊困脾